在体外无效，体内经还原代谢产生甲硫基化合物而显示生物活性的非甾体抗炎药物是
A. 舒林酸
B. 塞来昔布
C. 吲哚美辛
D. 布洛芬
E. 萘丁美酮

正确答案：A。舒林酸

解析：本题考查舒林酸。舒林酸（A对）为非甾体抗炎药，属前体药物，它在体外无效，在体内经肝代谢，甲基亚砜基被还原为甲硫基化合物而显示生物活性。塞来昔布（B错）、吲哚美辛（C错）、布洛芬（D错）均为非前药。萘丁美酮（E错）为非酸性的前体药物，其本身无环氧合酶抑制活性。小肠吸收后，经肝脏首关代谢为活性代谢物，即原药6-甲氧基-2-萘乙酸起作用。